无牙颌切牙乳突是什么区
A. 主承托区
B. 副承托区
C. 缓冲区
D. 封闭区

正确答案：C。缓冲区

解析：本题考查无牙颌的功能分区。无牙颌切牙乳突是缓冲区（C对）。切牙乳突位于上颌腭中缝的前端,上颌中切牙腭侧的卵圆形的软组织突起。下方为切牙孔，有鼻腭神经和血管通过。覆盖该区的义齿基托组织面需适当缓冲，以免压迫切牙乳突产生疼痛。